献血者两次采全血的间隔不得少于
A. 2个月
B. 3个月
C. 4个月
D. 5个月
E. 6个月

正确答案：E。6个月

解析：《献血法》规定，血站对献血者每次采集血液量一般为200毫升，最高不得超过400毫升；献血间隔不得少于6个月（E对）。